治疗咽喉肿痛,用点刺出血的方法应首选
A. 列缺
B. 鱼际
C. 太渊
D. 孔最
E. 少商

正确答案：E。少商

解析：少商治疗咽喉肿痛点刺出血（E对）。列缺治疗咽喉肿痛向上斜刺（A错）。鱼际治疗咽喉肿痛宜直刺（B错）。太渊治疗咽喉肿痛宜直刺（C错）。孔最治疗咽喉肿痛宜直刺（D错）。